首先到达病原体感染部位的免疫细胞是
A. T细胞
B. 巨噬细胞
C. NK细胞
D. B细胞
E. 中性粒细胞

正确答案：E。中性粒细胞

解析：成熟中性粒细胞表面表达多种模式识别受体，摘获LPS的受体CD14、甘露糖受体、清道夫受体、多糖受体、N甲酰甲硫氨酸变体，以及e受体、补体受体CR3和CR4，所以感染发生时中性粒细胞首先到达炎症部位，6h左右数量可达高峰，约增加10倍以上（E对）。